卫生法律文件的效力范围为
A. 只包括时间效力
B. 只包括空间效力
C. 只包括对人的效力
D. 不包括空间效力
E. 包括时间效力、空间效力和对人的效力

正确答案：E。包括时间效力、空间效力和对人的效力